中药五味子中所含的主要木脂素是
A. 简单木脂素
B. 单氧环木脂素
C. 环木脂内酯木脂素
D. 联苯环辛烯型木脂素
E. 新木脂素

正确答案：D。联苯环辛烯型木脂素